提取中药原生苷成分时可选溶剂
A. 盐酸溶液
B. 沸水
C. 硫酸溶液
D. 乙醇
E. 甲醇

正确答案：B、D、E。沸水；乙醇；甲醇

解析：本题考查的是中药原生苷成分的提取。提取中药原生苷成分时可选溶剂沸水（B对）、乙醇（D对）、甲醇（E对）。在提取原生苷时，必须抑制或破坏酶的活性。一般常用的方法是在中药中加入一定量的碳酸钙，或采用甲醇、乙醇或沸水提取，同时在提取过程中还须尽量避免与酸和碱接触。